关于黄体功能不足不正确的是
A. LPD指有卵泡发育及排卵，但黄体期孕激素分泌不足或黄体过早衰退，导致子宫内膜分泌反应不良
B. LH脉冲峰值不高，促进黄体形成的功能减弱
C. LH排卵峰后LH低脉冲缺陷，使黄体发育不全
D. 月经周期正常，但经期延长，甚至可达10日以上，且出血量多
E. 卵泡期颗粒细胞数量减少和功能分化缺陷，引起排卵后颗粒细胞黄素化不良及分泌孕酮量不足

正确答案：D。月经周期正常，但经期延长，甚至可达10日以上，且出血量多

解析：子宫内膜不规则脱落临床表现：月经周期正常，但经期延长，甚至可达10日以上，且出血量多。掌握“功能失调性子宫出血”知识点。